男，50岁。近半年来每于饱餐后快步行走时出现剑突下闷痛，停止活动后数分钟自行缓解。缓步行走时无类似症状发作，既往有糖尿病病史10余年，未规范治疗。查体：BP120/80mmHg，双肺呼吸音清，未闻及干湿性啰音，心率76次/分，律齐，各瓣膜听诊区未闻及杂音，腹软，无压痛。该患者最可能的诊断是
A. 急性心肌梗死
B. 稳定性心绞痛
C. 慢性胃炎
D. 糖尿病胃轻瘫
E. 消化性溃疡

正确答案：B。稳定性心绞痛

解析：老年男性患者，近半年来每于饱餐后快步行走时（诱因）出现剑突下（部位）闷痛（疼痛性质），停止活动后（缓解方式）数分钟（持续时间）自行缓解。该患者最可能的诊断是稳定性心绞痛（B对）。慢性胃炎（C错）大多数病人无明显症状。即便有症状也多为非特异性。可表现为中上腹不适、饱胀、钝痛、烧灼痛等，也可呈食欲缺乏、嗳气、泛酸、恶心等消化不良症状（P355）。消化性溃疡（E错）慢性病程，周期性发作，节律性上腹痛，NSAIDs服药史等是疑诊PU的重要病史（P359）。急性心肌梗死（A错）疼痛程度更剧烈，持续时间多超过30分钟，可长达数小时，可伴有心律失常、心力衰竭或（和）休克，含用硝酸甘油多不能缓解（P239）。糖尿病胃轻瘫（D错）为胃排空延迟，出现恶心、呕吐（P731）。